活髓切断术后牙髓的病理变化
A. 牙髓钙变
B. 根管内吸收
C. 牙髓活力正常
D. 根髓固定纤维化
E. 根管口形成硬组织桥

正确答案：D。根髓固定纤维化

解析：本题考查活髓切断术后牙髓的病理变化。活髓切断术是切除炎症牙髓组织，以盖髓剂盖于牙髓断面，保留正常牙髓组织的方法。活髓切断术后，牙髓断面发生急性炎症反应或表层坏死。随着时间推移可出现3种组织变化：①在断面处形成牙本质桥，牙髓面有排列整齐的成牙本质样细胞形成规则的牙本质，封闭根管口，使根髓保持正常活力；②断面处形成不规则钙化物，预备窝洞时磨除的牙本质碎屑被压到根髓断面，成为钙化中心，形成不规则钙化物；③断面处有部分牙本质桥形成，根髓已发展为慢性炎症，或发生内吸收。故总的病理变化是使根髓固定纤维化（D对）。活髓切断术后，可能会出现牙髓钙变（A错），根管内吸收（B错）和牙髓坏死（C错）等潜在并发症，不属于活髄切断术后牙髓的病理变化。活髓切断术后会在断面处形成牙本质桥，而不一定是在根管口处形成硬组织桥（E错）。